钝性分离最常使用的分离器械是
A. 锐性的手术刀
B. 手术剪
C. 血管钳
D. 刀柄
E. 手指

正确答案：C。血管钳

解析：钝性分离用于正常肌肉和疏松结缔组织的分离以及有包膜的良性肿瘤的摘除。主要以血管钳进行，也可使用刀柄、手指、纱布等，可在非直视下进行。掌握“口外手术组织切开、止血及组织分离”知识点。